根据《进口药材管理办法》不得作为首次进口药材审批的申请人或者备案单位的是
A. 中国境内的中成药上市许可持有人
B. 中药生产企业
C. 中药材专业市场
D. 具有中药饮片经营范围的药品经营企业

正确答案：C。中药材专业市场

解析：本题考查进口药材管理办法。根据《进口药材管理办法》不得作为首次进口药材审批的申请人或者备案单位的是中药材专业市场（C错，为本题正确答案）。《进口药材管理办法》所称药材进口单位是指办理首次进口药材审批的申请人或者办理进口药材备案的单位。药材进口单位，应当是中国境内的中成药上市许可持有人（A对）、中药生产企业（B对），以及具有中药材或者中药饮片经营范围的药品经营企业（D对）。